有关消化性溃疡的病史，下列哪项描述不确切
A. 具有节律性周期性发作
B. 肝浊音区消失，应疑及溃疡穿孔
C. 45岁以上十二指肠溃疡患者持续大便隐血阳性，考虑癌变可能
D. 部分患者以上消化道出血为首发症状
E. 出血后可使原有的溃疡症状减轻

正确答案：C。45岁以上十二指肠溃疡患者持续大便隐血阳性，考虑癌变可能